双悬果呈椭圆形，分果背面有5条突起纵棱的药是
A. 蛇床子
B. 砂仁
C. 薏苡仁
D. 牵牛子
E. 地肤子

正确答案：A。蛇床子

解析：本题考查的是蛇床子药材的性状鉴别。双悬果呈椭圆形，分果背面有5条突起纵棱的药是蛇床子（A对）。蛇床子：【性状鉴别】药材为双悬果，呈椭圆形。表面灰黄色或灰褐色，顶端有2枚向外弯曲的柱基，基部偶有细梗。分果的背面有薄而突起的纵棱5条，接合面平坦，有2条棕色略突起的纵棱线。果皮松脆，揉搓易脱落，种子细小，灰棕色，显油性。气香，味辛凉，有麻舌感。砂仁（B错）：【性状鉴别】药材阳春砂、绿壳砂呈椭圆形或卵圆形，有不明显的三棱。表面棕褐色，密生刺状突起，顶端有花被残基，基部常有果梗。果皮薄而软。种子集结成团，具三钝棱，中有白色隔膜，将种子团分成3瓣，每瓣有种子5～26粒。种子为不规则多面体；表面棕红色或暗褐色，有细皱纹，外被淡棕色膜质假种皮；质硬，断面胚乳灰白色。气芳香而浓烈，味辛凉、微苦。薏苡仁（C错）：【性状鉴别】药材呈宽卵形或长椭圆形。表面乳白色，光滑，偶有残存的黄褐色种皮。一端钝圆，另端较宽而微凹，有1淡棕色点状种脐；背面圆凸，腹面有1条较宽而深的纵沟。质坚实，断面白色，粉性。气微，味微甜。牵牛子（D错）：【性状鉴别】药材似橘瓣状。表面灰黑色或淡黄白色，背面有1条浅纵沟，腹面棱线的下端有一点状种脐，微凹。质硬，横切面可见淡黄色或黄绿色皱缩折叠的子叶，微显油性。气微，味辛、苦，有麻感。加水浸泡后种皮呈龟裂状，手捻有明显的黏滑感。地肤子（E错）：【性状鉴别】药材呈扁球状五角星形。外被宿存花被，表面灰绿色或浅棕色，周围具膜质小翅5枚，背面中心有微突起的点状果梗痕及放射状脉纹5～10条；剥离花被，可见膜质果皮，半透明。种子扁卵形，黑色。气微，味微苦。